执业药师有权依法开办或领办
A. 药品生产企业、医院制剂室
B. 药品生产企业、药品检验所
C. 药品生产企业、药品经营企业
D. 药品经营企业、医院制剂室
E. 药品经营企业、药物研究所

正确答案：C。药品生产企业、药品经营企业

解析：本题考查执业药师。执业药师有权依法开办或领办药品生产企业、药品经营企业（C对）。执业药师是指经全国统一考试合格，取得《中华人民共和国执业药师职业资格证书》（以下简称《执业药师职业资格证书》）并经注册，在药品生产、经营、使用和其他需要提供药学服务的单位中执业的药学技术人员。凡从事药品生产、经营、使用的单位均应配备相应的执业药师，并以此作为开办药品生产、经营、使用单位的必备条件之一。故药品生产企业与药品经营企业均应配备相应的执业药师。